成人心肺复苏的顺序是
A. ABC
B. ACB
C. CAB
D. CBA
E. BAC

正确答案：C。CAB

解析：成人心肺复苏的顺序是CAB（C对）。